适应性体液免疫应答中最早产生的抗体分子是
A. IgD
B. IgE
C. IgA
D. IgG
E. IgM

正确答案：E。IgM

解析：适应性免疫应答是指体内T、B淋巴细胞接受“非己”的物质（主要指抗原，见第三章）刺激后，自身活化、增殖、分化为效应细胞，产生一系列生物学效应（包括清除抗原等）的全过程（P2）。IgM（E对）是个体发育过程中最早合成和分泌的抗体也是初次体液免疫应答中最早出现的抗体，是机体特异性抗感染的“先头部队”；IgD（A错）为B细胞分化发育成熟的标志，不直接参加体液免疫；IgE（B错）主要介导Ⅰ型超敏反应，是一种异常的适应性免疫应答；IgA（C错）主要由粘膜中的浆细胞分泌，主要参与粘膜的适应性免疫；IgG（D错）主要在在再次免疫应答中产生，在初次免疫应答中出现的时间也要晚于IgM（P144图13-7）。